游离皮片移植皮片越厚，则
A. 越容易成活
B. 越能耐受摩擦
C. 色泽变化越大
D. 收缩越大
E. 质地越脆

正确答案：B。越能耐受摩擦

解析：本题考查游离皮片移植。一般而言，皮片越厚，越能耐受摩擦（B对），质地、色泽、及收缩率等方面就越好，但成活能力下降（A错）；皮片越薄越容易成活，缺点是质地越脆（E错）、色泽变化越大（C错）、耐磨擦性越差，收缩也越大（D错）。